脾的生理功能是
A. 主升发和藏血
B. 主气血的输布
C. 主气化和输布水液
D. 主纳降和转输水谷精微
E. 主统血和运化水谷

正确答案：E。主统血和运化水谷

解析：脾的生理功能包括脾主运化和脾主统血两方面（E对）。脾主运化是整个饮食物代谢过程的中心环节，也是后天维待生命活动的主要生理功能。便于理解，分为运化谷食（以固态食物为主）与运化水饮（以液态水饮为主）两个方面。脾主统血，指脾气有统摄血液运行于脉中，不使其逸出于脉外的作用。脾气统摄血液的功能，际上是气的固摄作用的体现。脾的生理特性包括脾气宜升，脾喜燥恶湿两方面。